哪一种疾病最适合用肾上腺皮质激素
A. 慢性肾炎
B. 急性肾炎
C. 肾盂肾炎
D. 肾静脉血栓形成
E. 肾病综合征

正确答案：E。肾病综合征

解析：肾病综合征的治疗主要为应用糖皮质激素。掌握“慢性肾小球肾炎、肾病综合征”知识点。